假定某一筛选计划检查了1000人，又假定某病的流行率为4%，而这种筛选试验的灵敏度为90%，特异度为80%。根据这些资料判断，被筛选出来的阳性者中假阳性者数是
A. 40人
B. 4人
C. 72人
D. 192人
E. 768人

正确答案：D。192人

解析：本题考查假阳性率。假阳性率又称误诊率，即实际无病，但被筛检试验判断为阳性的百分比。 它反映的是筛检试验误诊病人的情况。某病的流行率为4%，则患该病的人为1000×4%＝40人，非病人数目为1000－40＝960人。已知特异度为80%，由特异度＝1－假阳性率，得出假阳性率为20%。根据式（7-6），被筛选出来的阳性者中假阳性者数是：960×20%＝192人（D对ABCE错）。